下颌骨骨折骨折段移位的最主要影响因素是
A. 咀嚼肌的牵拉作用
B. 骨折部位
C. 骨折线走行方向
D. 骨折段是否有牙
E. 外力大小与方向

正确答案：A。咀嚼肌的牵拉作用

解析：影响下颌骨骨折后骨折段移位的因素有：骨折的部位、外力的大小和方向、骨折线方向和倾斜度、骨折段是否有牙以及附着肌肉的牵拉作用等，其中各咀嚼肌的牵拉作用又是主要因素。常因不同部位骨折、不同方向的肌牵引而出现不同情况的骨折段移位。掌握“牙槽突骨折、颌骨骨折”知识点。